迅速出血后出现休克症状，表明至少己丢失全身总血量的
A. 10%
B. 15%
C. 20%
D. 25%
E. 30%

正确答案：C。20%

解析：识记内容。迅速出血后出现休克症状，表明至少己丢失全身总血量的20%（C对）。